治疗肾病综合征脾肾阳虚证，应首选
A. 真武汤合五苓散
B. 大补阴丸合猪苓汤
C. 参芪麦味地黄汤
D. 桂枝茯苓丸合五苓散
E. 知柏地黄丸

正确答案：A。真武汤合五苓散

解析：肾病综合征脾肾阳虚证治宜温阳健脾，化气行水，选用温阳利水的真武汤合温阳化气，行气利水的五苓散治疗（A对）。大补阴丸合猪苓汤适用于治疗肾病综合征阴虚湿热证（B错）。参芪麦味地黄汤益气养阴适用于慢性肾小球肾炎气阴两虚型（C错）。桂枝茯苓丸活血，化瘀合五苓散温阳化气，利湿行水适用于阳虚水湿内停瘀血阻滞之证（D错）。知柏地黄丸功用滋阴降火适用于隐匿性肾小球肾炎阴虚火旺证（E错）。